女，51岁。绝经5年，阴道脱出肿物，检査宫颈及部分宫体脱出阴道口外。患者的治疗采用的方式是
A. 阴道前壁修补术
B. Manchester手术
C. 阴道纵膈成形术
D. 经阴道子宫全切及阴道前后壁修补术
E. 子宫悬吊术

正确答案：D。经阴道子宫全切及阴道前后壁修补术

解析：患者为中老年女性，因阴道脱出肿物就诊，检査宫颈及部分宫体脱出阴道口外（Ⅱ度重型：宫颈及部分宫体脱出阴道口），诊断为Ⅱ度重型子宫脱垂。患者年龄较大，已绝经，应考虑经阴道子宫全切及阴道前后壁修补术（D对）。阴道前壁修补术（A错）主要用于治疗阴道前壁膨出。Manchester手术（曼氏手术）（P289）（B错）包括阴道前后壁修补、主韧带缩短及宫颈部分切除术，适用于年龄较轻、宫颈延长的子宫脱垂患者。阴道纵隔形成术（C错）仅适合于年老体弱不能接受较大手术，且无需保留性交功能者。子宫悬吊术（E错）主要适用于支撑子宫相应韧带和结构受损的子宫脱垂。